急性心肌梗死时，特异性最高的血清标志物是
A. LDH
B. α-HBDH
C. SGOT
D. TnI
E. CPK

正确答案：D。TnI

解析：对于心肌损伤特异性高的指标有：TnI（D对）、TnT、CK-MB、CK亚型。LDH（乳酸脱氢酶）（A错）存在于人体多种组织细胞中，对于诊断灵敏度高，特异性低（P392）。α-HBDH（α-羟丁酸脱氢酶）（B错）是含有H亚基的LD-1和LD-2的总称，作用同LDH。SGOT（谷氨酸草酰乙酸转移酶）（C错）现在称为AST（天门冬氨酸氨基转移酶）可反映心脏和肝脏的损伤，对于急性心肌梗死的诊断缺乏特异性（P363）。CKP（肌酸磷酸激酶）（E错）是早期诊断心肌梗死的一项敏感指标，但特异性较低，对于心肌再次梗死的判断具有一定价值（P391）。